下列关于营养性缺铁性贫血的实验室检查叙述正确的是
A. 血清铁蛋白降低，血清铁降低，总结合力降低
B. 血清铁降低，总铁结合力增高，铁粒幼红细胞增加
C. 总铁结合力降低，血清铁降低，铁粒幼红细胞减少
D. 血清铁蛋白降低，红细胞游离原卟啉增高，血清铁降低
E. 红细胞游离原卟啉增高，铁幼粒红细胞增高，血清铁降低

正确答案：D。血清铁蛋白降低，红细胞游离原卟啉增高，血清铁降低

解析：血清铁蛋白反应体内储存铁的情况，在缺铁早期即可表现降低，应用放射免疫法测定，当血清铁蛋白<12μg/L时，提示缺铁。当缺铁时，红细胞游离原卟啉不能完全与铁结合成血红素，血红素合成减少，又反馈使红细胞游离原卟啉合成增多。当红细胞游离原卟啉>0.9μmol/L时，提示细胞内缺铁。血清铁、总铁结合力和转铁蛋白饱和度，这三项检查反映血浆中铁含量，通常在缺铁后期才出现异常，表现为血清铁降低，<9～10.7μmol/L有意义；总铁结合力增加，>62.7μmol/L有意义；转铁蛋白饱和度明显下降，<15%有诊断意义。骨髓可染铁，骨髓涂片红细胞内铁粒幼细胞数，如<15%，提示细胞内铁缺少，这是一项反映体内贮铁的敏感而可靠的指标（D对）。